患者男，53岁，教师。反复心前区疼痛4年，此次因受冷后复发现症见胸闷疼痛，感寒尤甚，痰多白黏，纳呆脘胀，形寒肢冷，舌淡红，苔白腻，脉弦滑检查：心电图示心肌缺血改变，血常规正常。其证型是
A. 痰瘀痹阻证
B. 气滞血瘀证
C. 寒凝心脉证
D. 痰浊痹阻证
E. 寒痰痹阻证

正确答案：E。寒痰痹阻证

解析：本病患者为心绞痛，因正气先虚，寒邪侵袭，心阳不振，失于温养，气血阻滞，运行不畅，不通则痛，则胸闷疼痛；寒邪郁滞，痰饮客肺，肺失宣降，肺气上逆，则咳痰量多白粘。寒湿内侵，中阳受困，运化失职，气机不畅，则纳呆脘胀。寒邪上阳，形体失于温煦，则形寒肢冷。舌淡红，苔白腻、脉弦，为寒痰痹阻之象，因此为寒痰痹阻证（E对）；痰瘀痹阻证，症见心烦、惊悸，动则喘促，甚则下肢水肿，不能平卧等（A错）；气滞血瘀证，症状：胸闷痛，如刺如绞，痛有定处，入夜为甚，甚则心痛彻背，背痛彻心，或痛引肩背，暴怒或劳累后加重，舌质紫暗，有瘀斑，苔薄，脉弦涩，或舌淡红，苔白腻，脉弦结、代（B错）；寒凝心脉证，症状：猝然心痛如绞，心痛彻背，喘不得卧，多因气候骤冷或骤感风寒而发病或加重，心悸，胸闷气短，手足不温，冷汗出，面色苍白，苔薄白，脉沉紧或沉细（C错）；痰浊痹阻证，症状：胸闷重而心痛微，痰多气短，肢体沉重，形体肥胖，遇阴雨天诱发或加重，倦怠乏力，纳呆便溏，咯吐痰涎，舌体胖大，边有齿痕，苔浊腻或白滑（D错）。